患者，男，65岁。体检结果：三酰甘油（TG）3.20mmol/L（正常参考范围0.56～1.70mmol/L），低密度脂蛋白胆固醇（LDL-C）2.6mmol/L（正常参考范围2.1～3.1mmol/L），高密度脂蛋白胆固醇（HDL-C）1.23mmol/L（正常参考范围1.03～2.07mmol/L），宜选用的调血脂药是
A. 依折麦布
B. 非诺贝特
C. 辛伐他汀
D. 氟伐他汀
E. 瑞舒伐他汀

正确答案：B。非诺贝特

解析：本题考查用药选择。根据题干判断患者三酰甘油较高，降低三酰甘油首选非诺贝特（B对）。依折麦布（A错）为胆固醇吸收抑制剂，用于治疗高胆固醇血症，可单独服用或与他汀类联合使用，由题干可知该患者胆固醇值处于正常范围，需要调整的是三酰甘油，不宜选用依折麦布进行治疗。辛伐他汀（C错）、氟伐他汀（D错）、瑞舒伐他汀（E错）均为调节血脂药，可治疗高胆固醇血症，但该患者胆固醇值处于正常范围，其需要调整的是三酰甘油，故不宜选用这三种他汀类药物进行治疗。